以下哪种营养素在绿叶蔬菜中含量较高
A. 维生素A
B. 维生素D
C. 硫胺素
D. 维生素E
E. 维生素C

正确答案：E。维生素C